鸟嘌呤N-7位烷化作用的后果有
A. 鸟嘌呤脱落
B. 脱嘌呤
C. 作用碱基缺失
D. 移码突变
E. 以上都是

正确答案：E。以上都是

解析：本题考查鸟嘌呤N-7位烷化作用的后果。鸟嘌呤N-7位烷化作用的后果有：鸟嘌呤脱落、脱嘌呤、作用碱基缺失和移码突变（E对ABCD错）。